骑跨式外伤最易损伤尿道是
A. 阴茎部
B. 球部
C. 膜部
D. 前列腺部
E. 膜上部

正确答案：B。球部

解析：骑跨式外伤最易损伤尿道球部（B对）。骨盆骨折容易伤及尿道膜部（C错），严重时可伤及尿道前列腺部（D错）。尿道阴茎部（A错）和膜上部（E错）处损伤较少见。